某高中开展一项健康教育活动，对于这项活动的结局评价，应该体现在哪个方面
A. 效果
B. 效益
C. 效应
D. 效果+效益
E. 效果+效应

正确答案：D。效果+效益